形成喉结的喉软骨是
A. 甲状软骨
B. 会厌软骨
C. 杓状软骨
D. 环状软骨
E. 气管软骨

正确答案：A。甲状软骨

解析：甲状软骨左､右软骨板的前缘互相融合处称前角，前角上端向前突出，称为喉结(A对）。